医学伦理学中尊重原则所涵盖的权利不包括
A. 自主选择权
B. 社会免责权
C. 个人隐私权
D. 知情同意权
E. 人格尊严权

正确答案：B。社会免责权

解析：尊重原则主要包括尊重病人的生命、人格、隐私权、自主权及处理好一些相关的特殊问题（ACE对），知情同意是病人自主选择权的具体体现（D对）。社会免责权（B错，为本题正确答案）属于人体实验现实伦理的范畴。